蛇咬伤后(神经毒)者，其治法是
A. 活血祛风
B. 清热解毒，凉血止血
C. 清利湿热，凉血息风
D. 凉血息风，豁痰
E. 清热解毒，活血凉血止血

正确答案：A。活血祛风

解析：中医认为蛇毒系风、火二毒，风者善行数变；火者生风动血，耗伤阴津。风毒（神经毒）证以风毒为主，兼有火毒，证候特点为局部伤口无红肿痛，仅有皮肤麻木感；全身症状有头昏眼花嗜睡气急，严重者呼吸困难，四肢麻痹，张口困难，眼睑下垂，神志模糊甚至昏迷；舌质红，苔薄白，脉弦数，故治法当活血祛风（A对）。清热解毒，凉血止血为火毒（血循毒）证的治法（B错）。清利湿热，凉血息风和凉血息风，豁痰都不是本病的治法（CD错）。活血祛风、清热解毒和凉血止血为风火毒（混合毒）证的治法（E错）。